牙齿受打击引起的牙体硬组织、牙髓或牙周组织急性损伤，称为
A. 牙外伤
B. 牙震荡
C. 牙折
D. 牙体缺损
E. 牙髓炎

正确答案：A。牙外伤

解析：牙外伤是指牙齿受急剧创伤，特别是打击或撞击所引起的牙体硬组织、牙髓或牙周组织发生急性损伤的一种疾病。掌握“牙外伤的预防”知识点。